羚羊角入汤剂宜
A. 先煎
B. 后下
C. 包煎
D. 另煎
E. 烊化

正确答案：D。另煎

解析：该题考查羚羊角的特殊煎药方法。另煎（P44）：又称另炖，主要是指某些贵重药材…也可与其他煎液混合服用（D对）。先煎（P43）：主要指有效成分难溶于水的一些金石、矿物…可以降低毒性，安全用药（A错）。后下（P44）：主要指一些气味芳香的药物…亦属后下之列（B错）。包煎（P44）：主要指那些粘性强、粉末状及带有绒毛的药物…加热时引起焦化或糊化（C错）。烊化（P44）：又称溶化，主要是指某些胶类药物…加热烊化后服用（E错）。